血管瘤其病程进入静止消退期一般是在
A. 出生以后
B. 1年以后
C. 2年以后
D. 3年以后
E. 4年以后

正确答案：B。1年以后

解析：消退期：一般在1年以后即进入静止消退期。消退是缓慢的，病损由鲜红变为暗紫、棕色，皮肤可呈花斑状。掌握“血管瘤与脉管畸形”知识点。